潜伏性感染的临床特征不包括
A. 并不是每种传染病中都存在
B. 常见病原体有单纯疱疹病毒等
C. 其病原体易排出体外
D. 一般不引起显性感染
E. 在人体免疫功能下降时可引起显性感染

正确答案：C。其病原体易排出体外

解析：潜伏性感染又称潜在性感染。定义为病原体感染人体后寄生于某些部位，由于机体免疫力足以将病原体局限化而不引起显性感染（D对），但又不足以将病原体清除时，病原体便可长期潜伏起来，待免疫功能下降时，则可引起显性感染（E对）。常见病原体有单纯疱疹病毒（B对）、水痘病毒等。潜伏性感染并不是在每种传染病中都存在（A对）。潜伏感染期间，病原体一般不排出体外（C错，为本题正确答案）。